腹部叩诊出现移动性浊音，应首先考虑的是
A. 尿潴留
B. 幽门梗阻
C. 右心功能不全
D. 巨大卵巢囊肿
E. 急性胃炎

正确答案：C。右心功能不全

解析：腹部叩诊出现移动性浊音提示有腹水存在，右心功能不全患者大量腹水，故腹部叩诊出现移动性浊音，应首先考虑的是右心功能不全（C对）。尿潴留为圆形浊音区（A错）。幽门梗阻可出现移动性浊音，但常伴有剧烈呕吐，且呕吐物常为大量宿食（B错）。巨大卵巢囊肿可出现腹部大面积浊音，其浊音为非移动性（D错）。急性胃炎腹胀明显者可出现叩诊鼓音（E错）。